苏子降气汤中当归及肉桂配伍意义是
A. 温肾纳气
B. 养血补肝
C. 温补下虚
D. 祛痰止咳
E. 温肾祛寒

正确答案：C。温补下虚

解析：本方为治疗痰涎雍盛，上实下虚之喘咳证。下虚，系指肾阳虚衰于下而失于纳气。方用紫苏子降上逆之肺气，消壅滞之痰涎，半夏燥湿化痰降逆，厚朴降逆平喘，宽胸除满，前胡降气祛痰，肉桂温肾纳气，当归心甘温润，既止咳而逆上气，又可养血补虚以助肉桂温补下元（C对），生姜、苏叶宣肺散寒，诸药合用，标本兼治，治上顾下，使气降痰消，则咳喘自平。